男，13岁。参加剧烈活动后右膝关节前下方出现疼痛。查体：右胫骨结节明显隆起压痛，伸膝时疼痛加重，膝关节活动范围正常，无明显红热表现。X线显示右胫骨结节处骨骺隆起碎裂。最可能的诊断是
A. 化脓性关节炎
B. 胫骨平台骨折
C. 关节结核
D. 类风湿关节炎
E. 胫骨结节骨软骨病

正确答案：E。胫骨结节骨软骨病

解析：青少年男性患者，剧烈运动后，右膝关节前下方疼痛、右胫骨结节明显隆起压痛、伸膝时疼痛加重（胫骨结节骨软骨病主要表现），无明显红热表现（提示病变处无炎症反应），X线显示右胫骨结节处骨骺隆起碎裂（胫骨结节骨软骨病典型影像学表现），结合患者病史、临床表现和影像学检查，该患者最可能的诊断为右胫骨结节骨软骨病（E对）。胫骨结节骨软骨病常见于12～14岁好动的男孩，多有剧烈运动史，表现为胫骨结节处疼痛、肿胀，明显的压痛。X线可见胫骨结节骨骺增大、致密或碎裂，周围软组织肿胀等。化脓性关节炎（P746）（A错）多见于儿童，突发寒战高热，病变局部红、肿、热、痛明显，X线早期只可见关节周围软组织肿胀影，后期出现关节挛缩畸形，关节间隙狭窄等。胫骨平台骨折（P671）（B错）多有明显的外伤史，可表现为膝关节疼痛、肿胀、下肢不能负重等，X线可明确提示骨折部位。关节结核（P750）（C错）常有明显的全身低热、盗汗等症状，局部穿刺活检可确诊。类风湿关节炎（P766）（D错）主要表现为慢性、对称性、多滑膜关节炎和关节外病变，早期X线表现为关节间隙增宽，关节周围骨质疏松。